急性感染指病程在
A. 3天以内
B. 1周以内
C. 10天以内
D. 2周以内
E. 3周以内

正确答案：E。3周以内

解析：根据病程长短可分为急性、亚急性与慢性感染。病程在3周之内为急性感染。掌握“外科感染”知识点。